下列属于糖尿病自主神经病变表现的是
A. 直立性低血压
B. 动眼神经麻痹
C. 肌紧张减低
D. 共济失调
E. 肢端感觉异常

正确答案：A。直立性低血压

解析：糖尿病的神经系统并发症分别包括：中枢神经系统并发症，周围神经病变，自主神经病变。其自主神经病变多影响胃肠、心血管、泌尿生殖系统等。临床表现为胃排空延迟、直立性低血压（A对）、尿失禁、尿潴留等。动眼神经麻痹（B错）、肌张力降低（C错）、共济失调（D错）、肢端感觉异常（E错）均为周围神经病变的表现。